牙颈部洞应用
A. 侧壁固位
B. 潜凹固位
C. 鸠尾固位
D. 支架固位
E. 钉固位

正确答案：B。潜凹固位

解析：本题考查V类洞预备要点。牙颈部洞在咬合运动中，侧方（牙合）运动使牙受到颊、舌方向的力，在此力的作用下，会产生以牙颈部为中心的往返弯曲，使充填体出现与洞壁分离的趋势，为了防止充填体脱落，应在应在（牙合）轴线角和龈轴线角作倒凹或固位沟（B对）。侧壁固位是所有窝洞的基本固位形，若牙颈部窝洞仅靠侧壁固位，在牙颈部弯曲力的作用下，极易脱位（A错）。鸠尾固位用于双面洞，牙颈部洞多为单面洞，不需作鸠尾固位（C错）。支架固位不属于窝洞的固位形（D错）。 钉固位常用于银汞合金充填，多位于后牙牙合面，前牙舌窝，主要防止充填体水平移位（E错）。